十二指肠溃疡常好发于
A. 十二指肠水平部
B. 十二指肠升部
C. 十二指肠上部
D. 十二指肠降部
E. 十二指肠空肠曲

正确答案：C。十二指肠上部

解析：十二指肠溃疡好发于十二指肠上部(C对)的十二指肠球。